某县有20万人口，其中农村人口占60%，现欲对40岁以上农村居民糖尿病患病率进行调查。关于此调查研究，下列说法错误的是
A. 不能人为施加干预措施
B. 调查指标要精选，尽量用客观、灵敏、精确的定量指标
C. 调查项目中不能包括调查对象的姓名、地址、联系电话等个人信息
D. 调查可为直接观察法和直接采访法相结合
E. 正式调查前需要对调查员进行培训

正确答案：C。调查项目中不能包括调查对象的姓名、地址、联系电话等个人信息